重病后恢复期多属于
A. 正胜邪退
B. 邪去正虚
C. 邪盛正虚
D. 邪正相持
E. 正虚邪恋

正确答案：B。邪去正虚

解析：邪去正虚，多指正气抗御邪气，邪气退却而正气大伤的病理状态，多见于重病的恢复期，其转归趋向好转的，痊愈的（B对）。正胜邪退（A错）指在疾病过程中，正气奋起抗邪，正气逐渐强盛，而邪气逐渐衰减，疾病向好转和痊愈发展的一种病理变化。邪盛正虚（C错）指在疾病过程中，邪气亢盛，正气虚弱，机体抗邪无力，疾病向恶化、危重，甚至向死亡方面转归的一种病理变化。邪正相持（D错）指在疾病过程中，机体正气不甚虚弱，而邪气亦不亢盛，则邪正双方势均力敌，相持不下，病情处于迁延状态的一种病理变化。正虚邪恋（E错）指正气大虚，余邪未尽，或邪气深伏伤正，正气无力去除病邪，致使疾病处于缠绵难愈的病理过程。